判断急性肾衰竭的指标
A. 7天内肌酐较基础值升高≥50%
B. 14天内肌酐较基础值升高≥50%
C. 48小时内肌酐较基础值升高≥50%
D. 检查发现肌酐较基础值升高≥50%
E. 30天内肌酐较基础值升高≥50%

正确答案：A。7天内肌酐较基础值升高≥50%

解析：按照最新国际AKI临床实践指南，符合以下情况之一者即可临床诊断AKI：①48小时内Scr升高≥0.3mg/dl（≥26.5umol/L)；②确认或推测7天内Scr较基础值升高≥50%（A对）；③尿量减少<0.5ml/（kg·h），持续≥6小时。